高泌乳素血症的药物治疗首选
A. 赛庚啶
B. 溴隐亭
C. 奥曲肽
D. 酮康唑
E. 黄体酮

正确答案：B。溴隐亭

解析：高泌乳素血症的药物治疗首选多巴胺激动剂。通过增强多巴胺的抑制作用可以减少催乳素分泌，恢复下丘脑-垂体促性腺激素周期性分泌及卵巢对促性腺激素的反应性，缩小肿瘤体积。该类药物主要有三种：溴隐亭（B对）、卡麦角林和培高利特。溴隐亭抑制乳汁分泌的机理：下丘脑会释放两种调控因子来调控腺垂体分泌催乳素，它们是催乳素释放因子和催乳素释放抑制激素，现已证实这个负性调控因子——催乳素释放抑制激素主要是多巴胺。所以用多巴胺受体激动剂如溴隐亭，来辅助负性调控因子增强抑制催乳素分泌的作用，催乳素分泌减少，即可达到抑制乳汁分泌的目的。赛庚啶（A错）为组胺受体拮抗剂，具有抗过敏作用，还具有中枢性抗胆碱及5-羟色胺的作用，主要用于治疗库欣病。奥曲肽（P659）（C错）为生长抑素类似物，可用于治疗生长激素瘤及胃泌素瘤。酮康唑（P702）（D错）可使皮质类固醇合成减少，主要用于库欣病的治疗。黄体酮（E错）为孕激素，具有抑制子宫平滑肌及促进子宫内膜增厚作用，为妇产科常用药。